2013年12月全国人民代表大会常务委员会将原药品管理法的第十三条修正为“经省、自治区、直辖市人民政府药品监督管理部门批准药品生产企业可以接受委托生产药品”，根据该规定，国家药品监督管理部门将药品委托生产行政许可职责下放到省级药品监督管理部门。这一法律适用过程体现
A. 不溯及既往原则
B. 全面审查原则
C. 法律条文到达时间的原则
D. 行政许可法定原则

正确答案：D。行政许可法定原则

解析：本题考查的是设定和实施行政许可的原则。2013年12月全国人民代表大会常务委员会将原药品管理法的第十三条修正为“经省、自治区、直辖市人民政府药品监督管理部门批准药品生产企业可以接受委托生产药品”，根据该规定，国家药品监督管理部门将药品委托生产行政许可职责下放到省级药品监督管理部门。这一法律适用过程体现行政许可法定原则（D对）。设定和实施行政许可的原则：1.法定原则：设定和实施行政许可，应当依照法定的权限、范围、条件和程序。2.公开、公平、公正原则：设定和实施行政许可，应当公开、公平、公正，维护行政相对人的合法权益。3.便民和效率原则：实施行政许可，应当便民，提高办事效率，提供优质服务。4.信赖保护原则：公民、法人或者其他组织依法取得的行政许可受法律保护，行政机关不得擅自改变已经生效的行政许可。行政许可所依据的法律、法规、规章修改或者废止，或者准予行政许可所依据的客观情况发生重大变化的，为了公共利益的需要，行政机关可以依法变更或者撤回已经生效的行政许可。由此给公民、法人或者其他组织造成财产损失的，行政机关应当依法给予补偿。法律的时间效力：时间效力是指法律在何时生效和何时终止效力，以及新法律颁布生效之前发生的事件或者行为是否适用该项法规的问题。时间效力一般有三个原则：不溯及既往原则（A错）；后法废止前法原则；法律条文到达时间的原则（C错）。行政复议的基本原则：1.合法原则；2.公正原则；3.公开原则；4.及时原则；5.便民原则；6.全面审查原则（B错）。